关于过氧乙酸，哪种说法是错误的
A. 气体和溶液均有较强的杀菌作用
B. 杀灭芽胞用1%，5分钟奏效
C. 杀灭繁殖体型微生物仅需0.01%～0.5%浓度
D. 适用于浸泡金属器械
E. 对乙肝病毒有杀灭作用

正确答案：D。适用于浸泡金属器械

解析：本题考查过氧乙酸。过氧乙酸对金属具有腐蚀性，不能用于金属器械的消毒，所以不适用于浸泡金属器械（D错，为本题的正确答案）。过氧乙酸其气体和溶液均有较强的杀菌作用（B对）；杀灭芽胞用1%，5分钟即可奏效（B对）；杀灭繁殖体型微生物仅需0.01%～0.5%浓度，30s～10min即可（C对）；对乙肝病毒有杀灭作用（E对）。